急性胰腺炎首选的影像学检查方法是
A. 腹部B超
B. 腹部X片
C. 增强CT扫描
D. MRI
E. 腹部透视

正确答案：A。腹部B超

解析：急性胰腺炎首选的影像学检查方法是腹部B超（A对），经济简便易行，对于急性胰腺炎应该首选。增强CT扫描（C错）增强CT 扫描：是最具诊断价值的影像学检查。不仅能诊断急性胰腺炎，而且能鉴别是否合并胰腺组织坏死，但是其操作复杂病人急性起病不应作为首选。MRI（D错）可提供与CT类似的信息，但CT价格较昂贵，一般不作首选检查。腹部X片（B错）及腹部透视（E错）主要用于胃肠道疾病的诊断，对急性胰腺炎的诊断价值不大。